既宣肺化痰，又止咳平喘的中成药是
A. 雪梨膏
B. 芒果止咳片
C. 咳嗽糖浆
D. 川贝清肺糖浆
E. 二母宁嗽颗粒

正确答案：B。芒果止咳片